用某种诊断方法判断为阳性的人中，实际有病的所占的比例称
A. 灵敏度
B. 特异度
C. 阳性预测值
D. 阴性预测值
E. 总符合率

正确答案：C。阳性预测值

解析：本题考查阳性预测值。用某种诊断方法判断为阳性的人中，实际有病的人所占的比例称阳性预测值（C对ABDE错）。